根据《城镇职工基本医疗保险定点零售药店管理暂行办法》，申办定点零售药店须
A. 经统筹地区卫生行政部门审查，并经药品监督管理部门确定
B. 经统筹地区卫生行政部门审查，并经劳动保障行政部门确定
C. 经统筹地区劳动保障行政部门审查，并经社会保险经办机构确定
D. 经统筹地区劳动保障行政部门审查，并经药品监督管理部门确定
E. 经统筹地区药品监督管理部门审查，并经劳动保障行政部门确定

正确答案：C。经统筹地区劳动保障行政部门审查，并经社会保险经办机构确定

解析：本题考查定点零售药店管理。《城镇职工基本医疗保险定点零售药店管理暂行办法》第二条规定，定点零售药店是指经统筹地区劳动保障行政部门审查，并经社会保险经办机构确定的（C对），为城镇职工基本医疗保险参保人员提供处方外配服务的零售药店。